女，23岁。2个月前无明显诱因出现自言自语，有时独自发笑，有时对空谩骂，感觉被人监视和跟踪，思想和行为会被某种外力控制，情绪低落，觉得被逼得走投无路，曾报警寻求保护，睡眠差，实验室检查未发现异常。患者在药物治疗两个月后，症状缓解，但出现停经和泌乳现象，最可能与该不良反应有关的多巴胺通路是
A. 中脑皮质通路
B. 中脑边缘系统通路
C. 黑质纹状体通路
D. 中脑被盖区通路
E. 下丘脑结节漏斗通路

正确答案：E。下丘脑结节漏斗通路

解析：该不良反应是由药物引起催乳素水平升高所导致的不良反应，与下丘脑至垂体的结节漏斗通路（E对）有关。脑内多巴胺能系统有四条投射通路，包括：与药源性阴性症状和抑郁有关的中脑皮质通路（A错）；与抗幻觉妄想等抗精神病作用有关的中脑边缘通路（B错）；与锥体外系副作用有关的黑质纹状体通路（C错）；与催乳素水平升高导致的副作用有关的下丘脑至垂体的结节漏斗通路。并不包含中脑被盖区通路（D错）。